不宜采用“急则治其标”的病证是
A. 小便癃闭
B. 大便秘结
C. 水肿喘满
D. 暴衄不止
E. 虚人感冒

正确答案：E。虚人感冒

解析：本题考查的是标本缓急。不宜采用“急则治其标”的病证是虚人感冒（E错，为本题正确答案）。标本缓急，是指针对疾病过程中各种矛盾的主次关系、轻重缓急的复杂病变，采取不同的治疗法则。标、本是一个相对的概念，如从邪正双方比较，正气是本，邪气是标；从病因与症状看，病因是本，症状是标；从疾病先后看，旧病、原发病是本，新病、继发病是标；从病位看，脏腑精气病变是本，肌表经络病变是标。（一）急则治标：急则治标，指在疾病过程中出现某些急重症状、病情严重，不及时救治可能危及生命，必须要采取紧急措施，针对症状治疗的治疗法则。如急性大出血的患者（D对），不论属于何种出血，均应采取应急措施，首先止血以治其标，并及时探究出血原因，治其本病。鼓胀患者，针对腹水大量增加，腹部胀满，呼吸喘促（C对），大小便不利（AB对）等紧急情况，应先利水、逐水以改善症状，待腹水减轻，病情稳定后，再调理肝脾，治其本病。再如某些慢性病急性发作患者，原有宿疾，又复感外邪而患新病，当新病较急的时候，亦应先治新病以治其标，待其愈后，再治宿疾以求其本。治标只是在应急情况下的权宜之计，而治本才是解决疾病的根本之图。急则治标，可缓解病情、解除新病，即为治本创造了更为有利的条件，其目的仍是为了更好地治本。并且，治标的方法可暂用而不宜常用，否则对正气将有所损害。（二）缓则治本：缓则治本，指在病情缓和、病势迁延、暂无急重症状的清况下，抓住疾病的本质进行治疗。因标病产生于本病，本病得治，标病自然也随之而去。缓则治本治则，对慢性病或急性病恢复期的治疗有重要指导意义。如肺痨咳嗽，其本多为肺肾阴虚，应滋养肺肾之阴以治其本。治疗热病后期，阴伤液亏，应养胃滋肾进行治疗。（三）标本兼治：标本兼治，指在标本俱急、或标本俱缓时，当标本同时进行治疗。如身热、腹硬满痛、大便燥结、口干渴、舌燥苔焦黄等，此属邪热里结为标，阴液受伤为本，标本俱急，治当标本兼顾，可用增液承气汤治之。又如虚人感冒，素体气虚，反复外感，治宜益气解表，益气为治本，解表为治标。标本缓急的治疗法则，既有原则性，又有灵活性。临床应用或先治本，或先治标，或标本兼治，应视病情变化适当掌握，最终目的在于抓住疾病的本质，有的放矢，正确治疗。